甲状腺上动脉通常起于
A. 甲状颈干
B. 颈总动脉
C. 颈外动脉
D. 颈内动脉
E. 锁骨下动脉

正确答案：C。颈外动脉

解析：颈外动脉（C对）的分支有甲状腺上动脉等8条分支，其中甲状腺上动脉分布于甲状腺和喉。